药物经济学的服务对象不包括
A. 医疗保险公司
B. 医生
C. 病人
D. 医疗服务的供方
E. 医疗事故民事诉讼方

正确答案：E。医疗事故民事诉讼方